复杂袋是指
A. 累及1个牙面的牙周袋
B. 累及2个牙面的牙周袋
C. 累及3个牙面的牙周袋
D. 累及4个牙面的牙周袋
E. 螺旋形袋，起源于1个牙面，扭曲回旋于1个以上牙面或根分叉区

正确答案：E。螺旋形袋，起源于1个牙面，扭曲回旋于1个以上牙面或根分叉区

解析：本题考查牙周袋的类型。牙周袋可按其累及牙面的情况分为3种类型：复杂袋是一种螺旋形袋，起源于一个牙面，但扭曲回旋于一个以上的牙面或根分叉区（E对）。单面袋只累及一个牙面（A错）。复合袋累及2个以上的牙面，累及2、3、4个牙面的牙周袋属于复合袋（BCD错）。